关于甲状舌管囊肿，哪一项是不正确的
A. 可发生于颈正中线上任何部位
B. 多见于1～10岁的儿童
C. 若囊肿发生于舌盲孔下面或前后部，可随吞咽上下移动
D. 不会发生癌变
E. 多无自觉症状

正确答案：D。不会发生癌变

解析：甲状舌管瘘如长期不治，还可以发生癌变。掌握“甲状舌管囊肿及鳃裂囊肿”知识点。